最好与铁剂同时服用的药物是
A. 维生素C
B. 维生素B₁
C. 四环素
D. 抗酸药
E. 碳酸钙

正确答案：A。维生素C